初孕妇，24岁，妊娠38周。既往血压正常。5天前突觉头痛且逐渐加重。BP166/112mmHg，双下肢水肿（++）。24小时尿蛋白5g，血细胞比容0.42。此时首选的处理是
A. 硫酸镁缓慢静脉注射
B. 呋塞米静脉注射
C. 硝普钠静脉滴注
D. 头颅CT检查
E. 立即行剖宫产术

正确答案：A。硫酸镁缓慢静脉注射

解析：该孕妇妊娠38周，既往血压正常（排除慢性高血压）。5天前突觉头痛且逐渐加重（重度子痫前期常有持续性头痛或视觉障碍或其他脑神经症状，提示颅内压升高），血压166/112mmHg（重度子痫前期收缩压≥160mmHg和（或）舒张压≥110mmHg），双下肢水肿（++），尿蛋白5g/24小时（重度子痫前期尿蛋白≥5.0/24h），根据患者的临床表现和实验室检查，最可能的诊断为重度子痫前期。妊娠37周后的重度子痫前期应终止妊娠（P70）。由于该患者现血压过高，且颅内压升高，不耐受立即手术，首选的处理是硫酸镁缓慢静脉注射（A对），预防重度子痫前期发展为子痫，并同时使用拉贝洛尔、硝苯地平、甘露醇等降低血压及颅内压，待病情控制后行剖宫产术（E错），终止妊娠。硝普钠静脉滴注（P69）（C错）降压过快，且代谢产物对胎儿有毒害作用，仅适用于其他降压药物无效的高血压危象孕妇。为防止妊娠期血液浓缩、有效循环血量减少和血液高凝，子痫前期患者不主张常规使用利尿剂，呋塞米静脉注射（B错）仅适用于出现全身水肿、肺水肿、脑水肿、急性心力衰竭的患者（P70）。该孕妇头痛考虑是由于妊娠期血压升高所致，头颅CT检查（D错）常用于诊断头颅外伤及颅内病变等。